甲状腺功能亢进病人的脉搏是
A. 细速脉
B. 无脉
C. 交替脉
D. 水冲脉
E. 奇脉

正确答案：D。水冲脉

解析：本题考查甲状腺功能亢进。甲状腺功能亢进病人的脉搏是水冲脉（D对）。1.水冲脉又称跳脉、陷落脉、水槌脉。是主动脉瓣关闭不全的周围血管征的一种。脉搏骤起骤落，犹如潮水涨落，故名水冲脉。正常人遇热、精神激动、妊娠、饮酒及血管扩张时均可有轻度水冲脉的表现。亦可见于甲状腺功能亢进、贫血、主动脉瓣关闭不全、肝衰竭及肺源性心脏病等。治疗针对病因进行。对症治疗。2.休克征兆：烦燥不安、面色苍白、肢体湿冷、脉细速（A错）、脉压差＜30mmHg。3.无脉（B错）指手部桡动脉无搏动或搏动减弱，不能触及，手掌部有动脉供血不足，一般无缺血坏死，严重患者有皮肤发凉、指端发绀及坏死。见于多发性大动脉炎、重度休克、动静脉瘘、动脉栓塞症等疾病。4.节律正常而交替出现一强一弱的脉搏,称交替脉（C错）。是心肌损害的表现，见于高血压心脏病、较严重的冠心病、左心衰竭、频发性心动过速和心房扑动等。5.吸气时脉搏显著减弱或消失的脉象称奇脉（E错）。常见于心包积液、缩窄性心包炎、高度肺气肿及重度哮喘等。